下列属于钩藤功效的是
A. 息风定惊，清热平肝
B. 息风止痉，平抑肝阳，祛风通络
C. 发表透疹，清热解毒，升举阳气
D. 息风止痉，通络止痛，攻毒散结
E. 清热定惊，通络平喘，利尿

正确答案：A。息风定惊，清热平肝

解析：钩藤味甘、性凉，归肝、心包经，具有息风定惊，清热平肝的功效（A对）。用于肝风内动，惊痫抽搐，高热惊厥，感冒夹惊，小儿惊啼，妊娠子痫，头痛眩晕。